连翘败毒丸的功能是
A. 清热解毒，消肿止痛
B. 清热解毒，凉血祛湿
C. 清热解毒，活血消肿
D. 清热解毒，祛风化湿
E. 清热解毒，凉血泻热

正确答案：A。清热解毒，消肿止痛

解析：本题考查的是连翘败毒丸的功能。连翘败毒丸的功能是清热解毒，消肿止痛（A对）。连翘败毒丸（煎膏、片）【功能】清热解毒，消肿止痛。小儿化毒散（胶囊）【功能】清热解毒，活血消肿（C错）。